面部的发育始于
A. 胚胎第3周
B. 胚胎第4周
C. 胚胎第5周
D. 胚胎第6周
E. 胚胎第8周

正确答案：A。胚胎第3周

解析：面部的发育始于胚胎第3周。掌握“面部的发育”知识点。